心率160次/min，心律无异常，不能使用的药物是
A. 利多卡因
B. 强心苷
C. 普萘洛尔
D. 美托洛尔
E. 比索洛尔

正确答案：B。强心苷

解析：患者心率160次/min，心律无异常，该患者无心功能不全合并快速型房扑或房颤的病史或表现，故不能使用的药物是强心苷（B错，为本题的正确答案）。